属于第一类溶剂的是
A. 乙醇
B. 甲醇
C. 聚乙二醇
D. 三氯甲烷
E. 四氯化碳

正确答案：E。四氯化碳

解析：本题考查溶剂分类。第一类溶剂是应该避免使用的溶剂，一般为致癌物或危害环境的物质。如苯、四氯化碳（E对）、1，2－二氯乙烷、1，1－二氯乙烯、1，1，1－三氯乙烷。